某药品批发企业用保健食品冒充药品销售该冒充品应
A. 按假药论处
B. 认定为劣药
C. 按劣药论处
D. 认定为假药

正确答案：D。认定为假药

解析：本题考查假药的界定。某药品批发企业用保健食品冒充药品销售该冒充品应认定为假药（D对）。假药的界定：《药品管理法》第九十八条第一款、第二款规定，禁止生产（包括配制，下同）、销售、使用假药。有下列情形之一的，为假药：①药品所含成分与国家药品标准规定的成分不符；②以非药品冒充药品或者以他种药品冒充此种药品；③变质的药品；④药品所标明的适应症或者功能主治超出规定范围。劣药的界定：根据《药品管理法》第九十八条第三款规定，有下列情形之一的，为劣药（B错）：①药品成分的含量不符合国家药品标准；②被污染的药品；③未标明或者更改有效期的药品；④未注明或者更改产品批号的药品；⑤超过有效期的药品；⑥擅自添加防腐剂、辅料的药品；⑦其他不符合药品标准的药品。